气溶胶包括
A. 粉尘、雾和烟
B. 气体、烟和蒸气
C. 气体、粉尘和烟
D. 气体、蒸气和雾
E. 蒸气、粉尘和烟

正确答案：A。粉尘、雾和烟

解析：本题考查气溶胶的概念。气溶胶是飘浮在空气中的粉尘、烟和雾（A对BCDE错）的统称。雾是悬浮于空气中的液体微滴，多由蒸气冷凝或液体喷洒而形成。烟是悬浮于空气中直径小于0.1㎛的固体微粒。粉尘是指能较长时间悬浮在空气中，其粒子直径为0.1～10㎛的固体微粒。